从乳浊液中除去挥发性溶剂制备微囊的方法为
A. 单凝聚法
B. 复凝聚法
C. 改变温度法
D. 液中干燥法
E. 溶剂-非溶剂法

正确答案：D。液中干燥法

解析：本题考查液中干燥法。液中干燥法（D对）是指从乳浊液中除去分散相挥发性溶剂以制备微囊的方法。